痛痛病是由下列哪项引起的
A. 慢性汞中毒
B. 慢性铅中毒
C. 慢性铬中毒
D. 慢性镉中毒
E. 慢性镍中毒

正确答案：D。慢性镉中毒

解析：本题考查痛痛病的发病原因。痛痛病是发生在日本富山县神通川流域部分镉污染地区的一种严重的环境污染性疾病，以全身剧烈疼痛为主要症状而得名，是慢性镉中毒（D对ABCE错）的典型案例。主要原因是当地居民长期饮用受镉污染的河水，并食用此水灌溉的含镉稻米，致使镉在体内蓄积，发生慢性镉中毒，导致了痛痛病的发生。